残冠、残根常成为病灶影响
A. 牙龈炎
B. 食物嵌塞
C. 全身健康
D. 垂直距离变短
E. 口腔黏膜软组织

正确答案：C。全身健康

解析：残冠、残根常成为病灶影响全身健康。掌握“牙体缺损病因及影响”知识点。